女，54岁。双腕、双手近端指间关节、掌指关节肿痛3年，晨僵1小时。查体：双腕、双手2～4掌指关节及3～4近端指间关节肿胀，压痛（+）；ANA（-）。最可能的诊断是
A. 强直性脊柱炎
B. 类风湿关节炎
C. 反应性关节炎
D. 骨关节炎
E. 痛风关节炎

正确答案：B。类风湿关节炎

解析：中年女性患者，双腕、双手2～4掌指关节及3～4近端指间关节肿胀和压痛，晨僵1小时（类风湿性关节炎典型表现），结合患者症状、体征和实验室检查，该患者最可能的诊断是类风湿性关节炎（B对）。强直性脊柱炎（P765）（A错）主要累及骶髂关节和脊柱，常表现为骶髂部疼痛、僵硬等。反应性关节炎（C错）是一种发生于某些特定部位（如肠道和泌尿生殖道）感染之后而出现的关节炎，主要累及膝、踝等下肢大关节，受累关节呈肿胀、剧痛等表现。骨关节炎（D错）好发于膝、髋等负重较大的关节。痛风关节炎（九版内科学P861）（E错）多发生于第一跖趾关节，主要表现为关节剧烈疼痛、功能障碍和红、肿、热、痛等炎症的表现，但不会出现关节晨僵。